关于初乳，下列哪项不正确
A. 呈淡黄色，含有丰富的脂质
B. 含蛋白质多
C. 含乳糖较少
D. 含β胡萝卜素多
E. 含大量免疫抗体，如分泌型

正确答案：A。呈淡黄色，含有丰富的脂质

解析：初乳为淡黄色的碱性液体，含脂肪（A错，为本题正确答案）、乳糖（C对）较少而蛋白质较多（B对），而维生素A即β胡萝卜素（D对）、牛磺酸和矿物质的含量也颇丰富，并含有初乳小球，可分泌大量的免疫抗体（E对），为新生儿提供免疫保护。